革兰氏染色法的步骤中，碘液媒染后需要用哪种材料进行脱色
A. 氯已定
B. 过氧化氢
C. 醇类
D. 洗必泰
E. 95%乙醇

正确答案：E。95%乙醇

解析：革兰氏染色法的步骤：细菌玻片涂片经结晶紫初染→碘液媒染→95%乙醇脱色→复红复染。凡未被95%乙醇脱色，菌体被结晶紫和复红染成紫色者为G+菌，而经乙醇脱色后，被复红染成红色者为G-菌。掌握“细菌的特殊结构及检查方法”知识点。